痛风急性发作期为抗炎镇痛和抑制白细胞对尿酸盐结晶的吞噬作用可选
A. 别嘌醇
B. 秋水仙碱
C. 泼尼松龙
D. 苯溴马隆
E. 双氯芬酸

正确答案：E。双氯芬酸

解析：本题考查痛风治疗药。痛风急性发作期为抗炎镇痛和抑制白细胞对尿酸盐结晶的吞噬作用可选双氯芬酸（E对）。别嘌醇（A错）是目前常用抑制尿酸生成的药物，是慢性痛风和痛风性肾病的首选药。秋水仙碱（B错）为痛风急性发作期首选药。波尼松龙（C错）为糖皮质激素类药物，可迅速缓解痛风症状，用于痛风急性期发作的治疗，但停药后易复发。苯溴马隆（D错）可抑制近端肾小管对尿酸盐的重吸收，使尿酸排出增加，从而降低血尿酸浓度。